在牙体与根尖周治疗后，能够重建牙体与牙周的连接关系的结构是以下哪一项
A. 牙本质
B. 牙釉质
C. 牙髓
D. 牙周膜
E. 牙骨质

正确答案：E。牙骨质

解析：当牙髓和根尖周治疗后，牙骨质能够新生并且覆盖根尖孔，重建牙体与牙周的连接关系。掌握“牙骨质”知识点。